患者，女，发作性喉间痰鸣气喘多年，因受寒发作1天，现症见：呼吸急促，喉中哮鸣有声，胸膈满闷如塞，咳不甚，咯吐不爽，痰稀薄色白，面色晦滞带青，口不渴，形寒畏冷，舌苔白滑，脉弦紧。其中医证型为
A. 寒饮犯肺证
B. 风寒犯肺证
C. 哮喘寒哮证
D. 哮喘热哮证
E. 哮喘肾虚证

正确答案：C。哮喘寒哮证

解析：患者寒痰伏肺，痰从寒化，遇风寒外感，寒饮内停，致痰升气阻，肺失宣降，肺管狭窄，通畅不利，而致喉中哮鸣有声，咳不甚，咯吐不爽，痰稀薄色白。可诊断为哮喘，患者痰稀薄色白，面色晦滞带青，口不渴，形寒畏冷，故为寒哮证（C对）。寒饮伏肺证症状：咳嗽，喘逆不得卧，咳吐清稀白沫痰，量多，遇冷空气刺激加重，甚至面浮肢肿，常兼恶寒肢冷，微热，小便不利，舌苔白滑或白腻，脉弦紧（A错）。风寒犯肺证症状：咳喘气急，胸部胀闷，痰白量多，伴有恶寒或发热，无汗，口不渴，舌苔薄白而滑，脉浮紧（B错）。哮喘热哮证症状；气粗息涌，咳呛阵作，喉中哮鸣，胸高胁胀、烦闷不安；汗出口渴喜饮，面赤口苦，咳痰色黄或色白，黏浊稠厚，咯吐不利，不恶寒。舌质红，苔黄腻，脉滑数或弦滑（D错）哮喘肾虚证症状；平素息促气短，呼多吸少，动则为甚；形瘦神疲心悸，腰酸腿软，脑转耳鸣，劳累后哮喘易发；或面色苍白，畏寒肢冷，自汗，或红，烦热，汗出黏手。舌淡苔白质胖，或舌红少苔，脉沉细或细数（E错）。